男性，28岁，半小时前躯干被压伤。主诉胸痛、胸闷、气急，烦躁不安，此时体格检查应特别注意的是
A. 胸部呼吸运动是否对称
B. 胸部挤压试验阳性伴骨摩擦音
C. 胸腹部开放性损伤
D. 腹式呼吸消失
E. 血压、脉搏、呼吸数据变化

正确答案：B。胸部挤压试验阳性伴骨摩擦音

解析：在对外伤进行检查时注意综合患者的主诉，所以应在检查时着重注意胸部的情况。应特别注意检查胸部挤压试验阳性伴骨摩擦音，查明是否存在肋骨骨折，以免刺破内脏。掌握“创伤和战伤”知识点。